小儿肺炎喘嗽，肺脾气虚证的治法是
A. 清热宣肺
B. 温肺化痰
C. 养阴清肺
D. 益气健脾
E. 以上均非

正确答案：D。益气健脾

解析：小儿肺炎喘嗽，肺脾气虚证治以益气健脾人参五味子汤（D对）。清热宣肺用于风热闭肺（A错）。温肺化痰用于风寒闭肺（B错）。养阴清肺用于阴虚肺热（C错）。